若按照年龄段区分，则根面龋为哪个年龄段的人群常见
A. 老年
B. 中年
C. 青少年
D. 婴幼儿
E. 普遍发生

正确答案：A。老年

解析：中老年人则多见根面龋。掌握“龋病的临床表现与分类”知识点。